经白质前连合交叉到对侧形成的纤维束是
A. 红核脊髓束
B. 脊髓丘脑束
C. 脊髓小脑后束
D. 顶盖脊髓束
E. 皮质脊髓侧束

正确答案：B。脊髓丘脑束

解析：脊髓丘脑束（B对）的纤维经白质前连合交叉至对侧时上升1-2节段。